立克次体感染宜选
A. 链霉素
B. 四环素
C. 磺胺嘧啶
D. 阿奇霉素
E. 多黏菌素

正确答案：B。四环素